甲状腺癌根治术时，Vl区（中央组）淋巴结清扫是指清扫
A. 颈内静脉中群淋巴结
B. 颈后角淋巴结
C. 下颌下淋巴结
D. 前上纵膈淋巴结
E. 颈总动脉内缘至气管旁的淋巴结

正确答案：E。颈总动脉内缘至气管旁的淋巴结

解析：颈部淋巴结根据结构从上到下的顺序分七区:颊下区和颌下区淋巴结为第I区（C错）；颈内静脉淋巴结分三组对应三区：上组为第Ⅱ区，中组为第Ⅲ区（A错），下组为第Ⅳ区；颈后三角区为第V区（B错）；颈动脉鞘内缘至气管旁（E对）和气管前区域为第VI区（中央组）（九版外科学中已改为气管周围淋巴结），包括环甲膜淋巴结，气管、甲状腺周围淋巴结，咽后淋巴结等。胸骨上凹下至前上纵膈淋巴结为第Ⅶ区（D错）。